《药品类易制毒化学品购用证明》的有效期是
A. 3个月
B. 1年
C. 5年
D. 3年

正确答案：A。3个月

解析：本题考查有效期的相关内容。《药品类易制毒化学品购用证明》的有效期是3个月（A对）。国家对药品类易制毒化学品实行购买许可制度。购买药品类易制毒化学品的，应当办理《药品类易制毒化学品购用证明》（以下简称《购用证明》），符合豁免办理《购用证明》情形（详见《药品类易制毒化学品管理办法》第21条）的除外。《购用证明》由国家药品监督管理部门统一印制，有效期为3个月。有效期为1年（B错）的是《麻醉药品、第一类精神药品运输证明》。《麻醉药品、第一类精神药品运输证明》有效期为1年（不跨年度）。有效期为5年（C错）的是《药品经营许可证》。药品经营许可证分为正本和副本，有效期为5年。有效期为3年（D错）的是《麻醉药品、第一类精神药品购用印鉴卡》。《麻醉药品、第一类精神药品购用印鉴卡》有效期为3年。